对雷尼替丁，哪一项是正确的
A. 可加速恢复皮肤黏膜创伤
B. 是H1受体阻断药
C. 只能用于治疗十二指肠溃疡
D. 对反流性胃炎无效
E. 属于H2受体阻断剂

正确答案：E。属于H2受体阻断剂

解析：皮肤黏膜变态反应性疾病，H1受体阻断药对荨麻疹、过敏性鼻炎等疗效较好，可作为首选药物，现多用第二代H1受体阻断药。而雷尼替丁属于H2受体阻断剂，主要用于抑制胃酸分泌，治疗胃和十二指肠溃疡。掌握“H1、H2受体阻断剂”知识点。